减少钠离子内流而使神经细胞膜稳定，属于乙内酰脲类抗癫痫药的是
A. 卡马西平
B. 苯妥英钠
C. 加巴喷丁
D. 苯巴比妥
E. 氯硝西泮

正确答案：B。苯妥英钠

解析：本题考查乙内酰脲类抗癫痫药。苯妥英钠（B对）属于乙内酰脲类抗癫痫药，通过减少钠离子内流而使神经细胞膜稳定；卡马西平（A错）属于二苯并氮䓬类，抗癫痫机制为阻滞电压依赖性的钠通道；氯硝西泮（E错）属于苯二氮䓬类抗癫痫病药，主要为GABA受体激动剂；加巴喷丁（C错）属于γ-氨基丁酸类似物，通过增加脑组织GABA的释放发挥作用；苯巴比妥（D错）属于巴比妥类，通过增强γ-氨基丁酸A型受体活性发挥作用。